适用于液态物料瞬间直接干燥的方法为
A. 冷冻干燥
B. 减压干燥
C. 微波干燥
D. 沸腾干燥
E. 喷雾干燥

正确答案：E。喷雾干燥

解析：本题考查干燥方法。适用于液态物料瞬间直接干燥的方法为喷雾干燥（E对）。喷雾干燥（A错）法是流态化技术用于浸出液干燥的一种较好方法，系直接将浸出液喷雾于干燥器内使之在与通入干燥器的热空气接触过程中，水分迅速汽化，从而获得粉末或颗粒的方法。最大特点是物料受热表面积大，传热传质迅速，水分蒸发极快，几秒钟内即可完成雾滴的干燥，且雾滴温度大约为热空气的湿球温度（一般约为50℃左右），特别适用于热敏性物料的干燥。冷冻干燥（A错）法系将浸出液浓缩至一定浓度后预先冻结成固体，在低温减压条件下将水分直接升华除去的干燥方法。适用于极不耐热物品的干燥，如天花粉针、淀粉止血海绵等。减压干燥（B错），又称真空干燥，系指在负压条件下而进行干燥的一种方法。适用于热敏性或高温下易氧化物料的干燥。微波干燥（C错）系指把物料置于高频交变电场内，从物料内部均匀加热，迅速干燥的一种方法。适用于含有一定水分而且对热稳定药物的干燥或灭菌，中药中较多应用于饮片、药物粉末、丸剂等干燥。沸腾干燥（D错），又称流床干燥，系指利用热空气流使湿颗粒悬浮，呈流态化，似“沸腾状”，热空气在湿颗粒间通过，在动态下进行热交换，带走水汽而达到干燥的一种方法。其特点是适于湿粒性物料，如片剂、颗粒剂制备过程中湿粒的干燥和水丸的干燥。